NH₃生成尿素通过
A. 柠檬酸循环
B. 嘌呤循环
C. 鸟氨酸循环
D. 丙酮酸循环
E. 核苷酸循环

正确答案：C。鸟氨酸循环